女，25岁。3个月前因工作失误受到领导批评，觉得脸上无光，觉得同事看不起她，在背后议论她，不好意思出门，耳边常有命令性幻听。查体：躯体及神经系统无阳性体征。该患者的诊断最可能的是
A. 抑郁症
B. 精神分裂症
C. 脑肿瘤所致精神障碍
D. 内分泌疾病所致精神障碍
E. 偏执性精神障碍

正确答案：B。精神分裂症

解析：该青年女性，3个月前觉得同事在背后议论她（关系妄想），耳边常有命令性幻听（听幻觉），不好意思出门（在妄想和幻觉的支配下表现的行为），躯体及神经系统无阳性体征。诊断依据患者为青年起病，以关系妄想和听幻觉为主要临床表现，在其支配下表现为不好意思出门，躯体及神经系统无阳性体征，故最可能诊断为精神分裂症（B对）。抑郁症以情感低落（忧愁、苦闷、唉声叹气、暗自落泪等）为主要表现，与本例不符（A错）。脑肿瘤所致精神障碍以智能障碍（注意力不集中、记忆力减退）为主，与本例不符（C错）。